“脾主升清”的确切内涵是
A. 脾的阳气主升
B. 脾以升为健
C. 脾气散精，上归于肺
D. 与胃的降浊相对而言
E. 输布津液，防止水湿内生

正确答案：C。脾气散精，上归于肺

解析：脾的阳气主升是脾的生理特性之一（A错）。脾以升为健是脾主升清的表现，而非确切内涵（B错）。脾主升清指的是脾气的升动，将胃肠吸收的水谷精微和水液上输于心、肺等脏，通过心、肺的作用化生气血，以营养濡润全身，即脾气散精，上归于肺（C对）。脾主升清与胃的降浊相对而言，二者相互为用，相反相成，选项本身无问题，但不符合题意（D错）。脾输布津液，防止水湿内生为脾主运化水湿的内荣（E错）。